治疗甲状腺功能亢进症阴虚火旺证，应首选
A. 他巴唑与逍遥散合二陈汤
B. 他巴唑与天王补心丹
C. 碘与知柏地黄丸
D. 他巴唑与生脉散
E. 碘液与龙胆泻肝汤

正确答案：B。他巴唑与天王补心丹

解析：甲状腺功能亢进症首选抑制甲状腺激素合成的他巴唑，甲状腺功能亢进症阴虚火旺证，治宜滋阴降火，消瘿散结，首选滋阴养血，补心安神的天王补心丹（B对）。逍遥散合二陈汤疏肝理气，化痰散结，为治疗甲状腺功能亢进症气滞痰凝证的代表方（A错）。知柏地黄丸滋阴降火，主治肝肾阴虚，虚火上炎证（C错）。生脉散为甲状腺功能亢进症气阴两虚证代表方（D错）。龙胆泻肝汤清肝泻火为甲状腺功能亢进症肝火旺盛证的代表方（E错）。